病例对照研究中调查者事先知道谁是病例谁是对照易发生
A. 选择偏倚
B. 信息偏倚
C. 混杂偏倚
D. 选择偏倚和混杂偏倚
E. 信息偏倚和混杂偏倚

正确答案：B。信息偏倚

解析：本题考查信息偏倚。信息偏倚又称观察偏倚，指在收集整理资料阶段由于观察和测量方法上有缺陷，使病例组和对照组获得不同的信息而产生系统误差。因此，病例对照研究中调查者事先知道谁是病例谁是对照易发生信息偏倚（B对ACDE错）。